痛风患者合并的泌尿系结石，最可能的是
A. 草酸钙结石
B. 磷酸盐结石
C. 碳酸盐结石
D. 黄嘌呤结石
E. 尿酸结石

正确答案：E。尿酸结石

解析：痛风是单钠尿酸盐沉积于骨关节、肾脏和皮下等部位，引发的急、慢性炎症和组织损伤，与嘌呤代谢紊乱及（或）尿酸排泄减少所致的髙尿酸血症直接相关。痛风患者合并的泌尿系结石多为尿酸结石（E对）。